属于短效苯二氮䓬类的药物是
A. 三唑仑
B. 艾司唑仑
C. 劳拉西泮
D. 替马西泮
E. 氟西泮

正确答案：A。三唑仑

解析：本题考查苯二氮䓬类药物。属于短效苯二氮䓬类的药物是三唑仑（A对）；艾司唑仑（B错）、劳拉西泮（C错）和替马西泮（D错）属于中效苯二氮䓬类药物；氟西泮（E错）、地西泮和夸西泮属于长效苯二氮䓬类药物。